可以治疗成人类风湿关节炎，也可用于治疗狼疮性肾炎的药物是
A. 羟氯喹
B. 双醋瑞因
C. 硫唑嘌呤
D. 来氟米特
E. 金诺芬

正确答案：D。来氟米特

解析：本题考查来氟米特的药理作用。来氟米特（D对）为抗风湿药，主要抑制合成嘧啶的二氢乳清酸脱氢酶，使活化淋巴细胞的生长受抑发挥作用。